烧伤最常见的死亡原因是
A. 脓毒血症
B. ARDS
C. 肾功能衰竭
D. 感染性休克
E. 心功能衰竭

正确答案：D。感染性休克

解析：感染是烧伤救治中的突出问题。感染如未能控制，其结果是内脏并发症接二连三，终因脓毒性休克、多器官功能衰竭而死亡。因此感染（D对）是烧伤最常见的死亡原因。脓毒血症（A错）、ARDS（B错）、肾功能衰竭（C错）、心功能衰竭（E错）均为烧伤的常见并发症，均可导致患者死亡。但是，这些并发症多因感染未能得到有效控制而引起。